不属于医德道德评价的是
A. 自我评价
B. 亲属评价
C. 同行评价
D. 社会评价
E. 他人评价

正确答案：B。亲属评价

解析：医学道德评价的主体是医学道德评价者，包括广泛的社会成员和社会组织。医学道德评价包括自我评价、同行评价、社会评价和他人评价；个体评价、群体评价和组织评价等。掌握“医学道德评价”知识点。